指出休克淤血性缺氧期微循环变化特点中哪项是错误的？
A. 后微动脉、毛细血管前括约肌舒张
B. 毛细血管后阻力降低
C. 微血管壁通透性升高、血浆渗出、血流淤滞
D. 微血流淤滞、泥化形成
E. 微循环淤血、回心血量减少、血压下降

正确答案：B。毛细血管后阻力降低

解析：休克淤血性缺氧期微循环血液流速显著减慢，红细胞和血小板聚集，白细胞滚动、贴壁、嵌塞、血黏度增大，血液泥化淤滞（CD对），微循环淤血，组织灌流量进一步减少，缺氧更为严重，故又称微循环淤血性缺氧期 。这是因为微动脉、后微动脉和毛细血管前括约肌收缩性减弱甚至扩张（A对），大量血液涌入真毛细血管网。微静脉虽也表现为扩张，但因血流缓慢，细胞嵌塞，使微循环流出道阻力增加，毛细血管后阻力（B错，为本题正确答案）大于前阻力而导致血液淤滞于微循环中。此期微循环灌流特点是：灌而少流，灌大于流，组织呈淤血性缺氧状态。